给兔静脉注射50%葡萄糖5ml后，尿量增多的主要原因是
A. 血浆胶体渗透压降低
B. 肾小球毛细血管血压增高
C. 小管液溶质浓度增加
D. 血浆晶体渗透压增高
E. 血容量增多

正确答案：C。小管液溶质浓度增加

解析：给兔静脉注射50%葡萄糖5ml，由于兔子血糖升高超过肾糖阈和肾小管的最大吸收能力，导致小管液葡萄糖浓度升高（C对），渗透压升高，由于渗透作用使一部分水保留在小管内，导致使小管液中的Na⁺被稀释而浓度降低，因此小管液和上皮细胞内Na⁺的浓度梯度减小，从而使Na⁺的重吸收减少或停止。小管液中较多的Na⁺又通过渗透作用保留相应的水，结果使尿量增多，NaCl排出量增多。注射葡萄糖后血浆胶体渗透压并不会降低（A错）。因为注射葡萄糖仅为5ml，所以毛细血管血压增高（B错）、血浆晶体渗透压（D错）、血容量增多（E错）也不是尿量增多的主要原因。